重度新生儿寒冷损伤综合征患儿复温时间为
A. 12～24小时
B. 0～1小时
C. 6～12小时
D. 24～36小时
E. 3～6小时

正确答案：A。12～24小时

解析：复温是治疗生儿寒冷损伤的主要治疗措施，重度新生儿寒冷损伤综合征（即肛温＜30℃的患儿）复温时间为12－24小时（A对）。轻度新生儿寒冷损伤综合征复温时间为6－12小时（C错）。